米非司酮结构中具有哪些基团
A. 11β-（4-二甲胺基苯基）
B. 9（10）双键
C. 17α-丙炔基
D. 1（2）双键
E. 17β-羟基

正确答案：A、B、C、E。11β-（4-二甲胺基苯基）；9（10）双键；17α-丙炔基；17β-羟基